某地农村产妇分娩一女婴。由于第三产程子宫收缩无力，产妇的胎盘迟迟未娩出。此时，无证个体医生王某，在一不消毒，二不戴消毒手套的情况下，将手伸进子宫，误认为还有一胎儿未娩出而向外猛拉子宫，当场造成产妇大出血死亡。根据《执业医师法》的规定，应依法追究王某的法律责任，但其法律责任不包括
A. 责令改正
B. 予以取缔
C. 没收违法所得及其药品器械
D. 赔偿责任
E. 刑事责任

正确答案：A。责令改正

解析：无证个体医王某为产妇接生，未取得医师资格而从事医疗活动，属于非医师行医，且造成产妇大出血死亡，已构成犯罪。根据《执业医师法》规定，非医师行医的，由县级以上人民政府卫生行政部门予以取缔（B对），而不是责令改正（A错，为本题正确答案），没收其违法所得（C对）及其药品、器械，并处10万元以下的罚款；对医师吊销其执业证书；给患者造成损害的，依法承担赔偿责任（D对）；构成犯罪的，依法追究刑事责任（E对）。